某女，60岁，患水肿，症见小便不利、水肿腹胀、呕逆泄泻、渴不思饮，医师选用五苓散治疗，此因五苓散的功能是
A. 温阳化气、利湿行水
B. 疏风散寒、解表清热
C. 清热利尿、补气健脾
D. 清湿热、利小便
E. 清热解毒、利尿通淋、益肾

正确答案：A。温阳化气、利湿行水

解析：本题考查的是五苓散的功能。患水肿，症见小便不利、水肿腹胀、呕逆泄泻、渴不思饮，医师选用五苓散治疗，此因五苓散的功能是温阳化气、利湿行水（A对）。五苓散：【功能】温阳化气，利湿行水。感冒清热颗粒：【功能】疏风散寒，解表清热（B错）。肾炎四味片：【功能】清热利尿，补气健脾（C错）。茵陈五苓丸：【功能】清湿热，利小便（D错）。三金片：【功能】清热解毒，利湿通淋，益肾（E错）。